以味酸者质量为佳的药材是
A. 桃仁
B. 枳壳
C. 酸枣仁
D. 女贞子
E. 乌梅

正确答案：E。乌梅

解析：本题考查的是乌梅的性状鉴别。以味酸者质量为佳的药材是乌梅（E对）。乌梅【性状鉴别】药材呈类球形或扁球形，直径1.5～3cm。表面乌黑色或棕黑色，皱缩不平，基部有圆形果梗痕。果核坚硬，椭圆形，棕黄色，表面有凹点；种子扁卵形，淡黄色。气微，味极酸。以个大、核小、柔润、肉厚、不破裂、味极酸者为佳。桃仁（A错）【性状鉴别】山桃仁：呈类卵圆形，较小而肥厚，长约0.9cm，宽约0.7cm，厚约0.5cm。以颗粒饱满、均匀、完整者为佳。枳壳（B错）【性状鉴别】药材呈半球形，直径3～5cm。外果皮棕褐色至褐色，有颗粒状突起，突起的顶端有凹点状油室；有明显的花柱残迹或果梗痕。切面中果皮黄白色，光滑而稍隆起，厚0.4～1.3cm，边缘散有1～2列油室，瓤囊7～12瓣，少数至15瓣，汁囊干缩呈棕色至棕褐色，内藏种子。质坚硬，不易折断。气清香，味苦、微酸。以外皮色棕褐、果肉厚、质坚硬、香气浓者为佳。酸枣仁（C错）【性状鉴别】药材呈扁圆形或扁椭圆形，长0.5～0.9cm，宽0.5～0.7cm，厚约0.3cm。表面紫红色或紫褐色，平滑有光泽，有的有裂纹。有的两面均呈圆隆状突起；有的一面较平坦，中间有1条隆起的纵线纹，另一面微隆起，边缘略薄。一端凹陷，可见线形种脐，另一端有细小突起的合点。种皮较脆，胚乳白色，子叶2，浅黄色，富油性。气微，味淡。以粒大、饱满、完整、有光泽、外皮红棕色、无核壳者为佳。女贞子（D错）【性状鉴别】药材呈卵形、椭圆形或肾形，长6～8.5mm，直径3.5～5.5mm。表面黑紫色或灰黑色，皱缩不平，基部有果梗痕或具宿萼及短梗。体轻。外果皮薄，中果皮较松软，易剥离，内果皮木质，黄棕色，具纵棱，破开后种子通常为1粒，肾形，紫黑色，油性。气微，味甘、微苦涩。